门静脉高压症的治疗错误的是
A. 下腔静脉与门静脉吻合易造成肝性脑病
B. 食管胃底静脉曲张非手术治疗首选内镜治疗
C. 内镜下食管静脉呈蓝色曲张需紧急手术
D. 食管胃底静脉曲张时可行食管内窥镜硬化剂注射治疗
E. 静脉点滴垂体后叶素治疗

正确答案：C。内镜下食管静脉呈蓝色曲张需紧急手术

解析：内镜下见食管胃底曲张静脉表面有红色征（不是蓝色征），提示静脉曲张程度重，为了预防首次急性大出血，可以考虑预防性手术（非紧急手术）（C错，为本题正确答案）。将下腔静脉与门静脉吻合，会使门静脉血流未经肝脏解毒完全进入下腔静脉，易造成肝性脑病（A对）。内镜治疗是食管胃底静脉曲张破裂出血非手术治疗首选方法（B对）。食管胃底静脉曲张时，可以食管内镜注入硬化剂，是曲张静脉闭塞，黏膜下组织硬化，达到止血目的（D对）。静滴垂体后叶素，可以收缩内脏小血管，减少门脉血流，降低门静脉压（E对）。